消费者有权根据商品或者服务的不同情况，要求经营者提供商品的
A. 产地、生产者
B. 用途、性能、规格
C. 主要成分
D. 生产日期、有效期限
E. 进货日期、进货价格

正确答案：A、B、C、D。产地、生产者；用途、性能、规格；主要成分；生产日期、有效期限

解析：本题考查消费者的权利。消费者享有知悉其购买、使用的商品或者接受的服务的真实情况的权利。消费者有权根据商品或者服务的不同情况，要求经营者提供商品的价格、产地、生产者（A对）、用途、性能、规格（B对）、等级、主要成分（C对）、生产日期、有效期限（D对）、检验合格证明、使用方法说明书、售后服务，或者服务的内容、规格、费用等有关情况。